日本水俣病产生的原因是
A. 慢性铅中毒
B. 慢性镉中毒
C. 慢性砷中毒
D. 慢性甲基汞中毒
E. 慢性四乙铅中毒

正确答案：D。慢性甲基汞中毒

解析：本题考查日本水俣病产生的原因。水俣病是因食入被有机汞污染河水中的鱼、贝类所引起的甲基汞为主的有机汞中毒或是孕妇吃了被有机汞污染的海产品后引起婴儿患先天性水俣病，是有机汞侵入脑神经细胞而引起的一种综合性疾病。因此水俣病产生的原因是慢性甲基汞中毒（D对ABCE错）。